下列不属于HBV基因组4个部分重叠的开放性读码框架（ORF）的是
A. S区
B. C区
C. P区
D. X区
E. Z区

正确答案：E。Z区

解析：HBV基因组含有4个部分重叠的开放性读码框架（ORF），即S区、C区、P区及X区。Z区是干扰选项。掌握“乙型肝炎病毒”知识点。